丙酸睾酮治疗子宫肌瘤每月总量不应超过
A. 150mg
B. 200mg
C. 250mg
D. 300mg
E. 350mg

正确答案：D。300mg

解析：丙酸睾酮治疗子宫肌瘤每月总量不应超过300mg（D对），其作用原理是：雄激素可对抗雌激素，使子宫内膜萎缩，作用于子宫平滑肌增强收缩减少出血，近绝经期，可提前绝经（3版实用妇产科学P549）。